婴幼儿患者合理使用中药的原则是
A. 不宜随便施补
B. 用量宜轻
C. 多宜温补
D. 宜用轻清之品
E. 尤宜兼顾健脾和胃

正确答案：A、B、D、E。不宜随便施补；用量宜轻；宜用轻清之品；尤宜兼顾健脾和胃

解析：本题考查的是婴幼儿患者合理应用中药的原则。婴幼儿患者合理使用中药的原则是不宜随便施补（A对）、用量宜轻（B对）、宜用轻清之品（D对）与尤宜兼顾健脾和胃（E对）。婴幼儿患者合理使用中药的原则：1.用药及时，用量宜轻。2.宜用轻清之品。3.宜佐健脾和胃之品。4.宜佐凉肝定惊之品。5.不宜滥用滋补之品（C错）。